疫源地是指
A. 传染源所在地
B. 病人所在地
C. 传染源及其排出的病原体向周围传播所能波及的地区
D. 存在病原体的地区
E. 以上都不是

正确答案：C。传染源及其排出的病原体向周围传播所能波及的地区

解析：本题考查疫源地的概念。疫源地是指传染源及其排出的病原体向周围播散所能波及的范围（C对ABDE错）。